维吾尔药的药性，系指根据药物作用于机体后发生的不同反应和疗效而决定的药物属性。不属于维吾尔药药性的是
A. 热
B. 湿
C. 寒
D. 干
E. 凉

正确答案：E。凉

解析：本题考查的是维吾尔药基础理论。维吾尔药的药性，系指根据药物作用于机体后发生的不同反应和疗效而决定的药物属性。不属于维吾尔药药性的是凉（E错，为本题正确答案）。维吾尔药的药性，系指根据药物作用于机体后发生的不同反应和疗效而决定的药物属性。这种药物的属性，称为药物的气质，又称药物的性质，简称药性。维吾尔医认为，药物的药性分为热（A对）、湿（B对）、寒（C对）、干（D对）四种，还有相当部分的药物具有混合的药物属性，即：干热、湿热、湿寒、干寒。还有一部分药物药性平和，称为“平”。